开放性伤口污染较重，处理时间已超过伤后12小时，其处理原则是
A. 伤口周围注射抗生素
B. 直接缝合伤口
C. 清创后一期缝合伤口
D. 清创引流，不缝合伤口
E. 创面涂擦抗生素软膏

正确答案：D。清创引流，不缝合伤口